在连续对某水体含氮化合物指标进行监测时发现，氨氨、亚硝酸盐氮、硝酸盐氮含量在不同时段变化不一。监测初期时，水体仅氨氮升高，大致可判断水体的污染状况为
A. 持续污染
B. 过去曾被污染
C. 过去和新近均有污染
D. 新近污染
E. 新近污染，自净完成

正确答案：D。新近污染

解析：本题考查水体的污染状况。氨氮是天然水被人畜粪便等含氮有机物污染后，在有氧条件下经微生物分解形成的最初产物。水体仅氨氮升高，大致可判断水体的污染状况为新近污染（D对ABCE错）。